打结是重要的手术基本功，要求组织内结扎线头所留长度一般为
A. 0.5mm左右
B. 1mm左右
C. 3mm左右
D. 5mm左右
E. 10mm左右

正确答案：B。1mm左右

解析：组织内结扎线头所留长度一般为1mm左右，但对较大的血管及大块肌肉束等粗线结扎，为防止滑脱可增加到3～4mm。掌握“口外手术打结、缝合及外科引流”知识点。